根据分析某医院20年来500例肺癌住院患者，吸烟者占80%，不吸烟者仅为20%，说明吸烟者易患肺癌
A. 正确
B. 不正确，因为没有进行统计学显著性检验
C. 不正确，因为只是一个医院的资料，代表性不够
D. 不正确，因为只是病例组吸烟率，而无对照组的吸烟率
E. 吸烟者肺癌发生率为不吸烟者的4倍

正确答案：D。不正确，因为只是病例组吸烟率，而无对照组的吸烟率